患者，女，28岁。乳房肿胀疼痛，皮肤微红，乳汁分泌不畅，恶寒发热，胸闷不舒，舌红苔薄黄，脉弦滑而数。用药宜首选
A. 鱼腥草
B. 蒲公英
C. 败酱草
D. 金银花
E. 野菊花

正确答案：B。蒲公英

解析：乳房肿胀疼痛，皮肤微红，乳汁分泌不畅为热毒壅盛所致，可以选清热解毒，消肿散结，利尿通淋，为治疗乳痈的要药的蒲公英（B对）。鱼腥草（A错）的功效是清热解毒，消痈排脓，利尿通淋，为治疗肺痈吐脓、肺热咳嗽要药。败酱草（C错）的功效是清热解毒，消痈排脓，祛瘀止痛，为治疗肠痈要药，尤宜于肠痈已成者。金银花（D错）的功效是清热解毒，疏散风热，为治疗热毒所致的一切痈疮疔疥的要药。野菊花（E错）的功效是清热解毒，泻火平肝，为治疗外科疔痈之良药。